下列感染性口腔黏膜疾病中临床以形成假膜损害为特征的是
A. 单纯疱疹
B. 带状疱疹
C. 手-足-口病
D. 球菌性口炎
E. 口腔结核

正确答案：D。球菌性口炎

解析：本题考查球菌性口炎。球菌性口炎（D对）是急性感染性口炎的一种，临床上以形成假膜损害为特征，故又称为膜性口炎。单纯疱疹（A错）临床上以出现簇集性小水疱为特征，有自限性，易复发，溃破后形成大面积糜烂，虽然上面也可形成黄色假膜，但不是该病的主要临床特征。带状疱疹（B错）由水痘带状疱疹病毒所引起，其临床特征是沿单侧周围神经分布的簇集性小水疱而不是形成假膜损害。手-足-口病（C错）的临床特征是以手、足和口腔黏膜疱疹或破溃后形成溃疡，虽然溃疡上面也可形成假膜，但不是该病的主要临床特征。口腔结核（E错）损害，最主要特征性变化为结缔组织中形成多个结节，结节的中心为无结构的干酪样物质。